12岁男孩子，半年前上前牙外伤冠折露髓未治，现因唇侧龈肿包就诊，医师必须做的检查是
A. 叩诊
B. 查松动度
C. 温度测试
D. X线片
E. 牙周袋探诊

正确答案：D。X线片

解析：本题考查慢性根尖周炎的诊断要点。根据该患者的外伤史和症状，单纯牙龈肿胀的可能性很低，应高度怀疑是慢性根尖周炎。因半年前上前牙外伤冠折露髓未治，细菌进入髓腔可能会引起牙髓炎症，继而坏死，导致根尖周炎，该患者12岁，牙周间隙疏松宽大，脓液易沿牙周膜引流，汇集到龈下，出现唇侧龈肿包，所以必须拍X线片（D对），以观察根周膜是否增宽，以确定是单纯的牙龈肿胀还是根尖周病引起的肿胀。根尖周病患者叩诊（A错）会疼痛，但是相比之下，X线片更有意义。该患牙牙髓已坏死，温度测试（C错）意义不大。确定牙齿松动度（B错），探诊（E错）袋的深度，只能起到辅助诊断作用，无法得知是单纯的牙龈肿胀还是根尖周病引起的肿胀。